应激时免疫系统参与神经内分泌的调控是通过
A. 感知病毒等非识别刺激
B. 通过免疫防御反应清除有害刺激
C. 免疫细胞可产生各种内分泌激素
D. 激素进入体循环，产生内分泌激素样作用
E. 以上都对

正确答案：E。以上都对

解析：感知病毒等非识别刺激（A对）、通过免疫防御反应清除有害刺激（B对）免疫细胞可产生各种内分泌激素（C对）和激素进入体循环，产生内分泌激素样作用（D对，故E为本题正确答案）是应激时免疫系统参与神经内分泌的调控。